伤寒最具特征性的病变部位在
A. 肝、胆囊
B. 肠系膜淋巴结
C. 结肠
D. 回肠下段集合淋巴结与孤立淋巴滤泡
E. 乙状结肠

正确答案：D。回肠下段集合淋巴结与孤立淋巴滤泡

解析：致病菌到达回肠下段，侵入回肠集合淋巴结的单核吞噬细胞内繁殖形成初发病灶，因此最具特征性的病变部位在回场下段集合淋巴结与孤立淋巴滤泡（D对），病变进一步侵入肠系膜淋巴结（B错）经胸导管进入血液循环，引起菌血症伤寒的病理变化。主要表现为单核～巨噬细胞系统的增生性反应，回肠下段附近肠系膜淋巴结常出现明显肿大、充血，肝、胆囊（A错）、结肠（C错）、乙状结肠（E错）病变不明显或无病变。